蔬菜和水果中含量较低的是
A. 水分
B. 脂肪
C. 矿物质
D. 粗纤维
E. 维生素

正确答案：B。脂肪